引起小儿颌下间隙感染的最多来源是
A. 外伤性
B. 牙源性
C. 血源性
D. 淋巴腺源性
E. 颌下腺源性

正确答案：D。淋巴腺源性

解析：本题考查下颌下间隙感染的感染来源。引起小儿颌下间隙感染的最多来源是淋巴腺源性（D对）。面部具有丰富的淋巴结，口腔、颜面及上呼吸道感染，可沿相应淋巴结引流途径扩散，发生区域性的淋巴结，特别是儿童淋巴结发育尚未完善，感染易穿破淋巴结被膜，形成结外间隙感染，引起小儿颌下间隙感染的最多来源是淋巴腺源性。外伤性虽有可能引起颌下间隙感染，但少见（A错）。牙源性感染是病原菌通过病变牙或牙周组织进入体内发生感染者，小儿病变牙少见（B错）。血源性是机体其他部位的化脓性病灶通过血液循环引起的口腔颌面部化脓性病变，不易引起颌下间隙感染（C错）。颌下腺源性感染多由于腺体导管内结石阻塞导管导致唾液排除受阻而继发炎症，有时可引起可继发下颌下间隙感染，以20～40岁多见（E错）。